根据《麻醉药品和精神药品管理条例》未取得麻醉药品处方资格的执业医师擅自开具麻醉药品的
A. 由药品监督管理部门取消其定点批发资格，并依照药品管理法的有关规定处罚
B. 由药品监督管理部门责令改正，给予警告，没收违法交易的药品，并处罚款
C. 由设区的市级人民政府卫生主管部门责令限期改正，给予警告
D. 由县级以上人民政府卫生主管部门给予警告，暂停其营业活动
E. 由药品监督管理部门责令限期改正，给予警告

正确答案：D。由县级以上人民政府卫生主管部门给予警告，暂停其营业活动

解析：本题考察特殊药品管理。未取得麻醉药品处方资格的执业医师擅自开具麻醉药品将由县级以上人民政府卫生主管部门给予警告，暂停其营业活动（D对）。